我国有关出生缺陷的信息，主要来源于
A. 主动监测
B. 被动监测
C. 哨点监测
D. 以实验室为基础的监测
E. 以医院为基础的监测

正确答案：E。以医院为基础的监测

解析：本题考查以医院为基础的监测。以医院为基础的监测（E对ABCD错）是指以医院为现场、以病人为对象开展工作，主要是对医院内感染、病原体耐药以及出生缺陷等进行监测。